中药斜片的厚度应为
A. 0.5～1mm
B. 1～2mm
C. 2～4mm
D. 4～5mm
E. 5～6mm

正确答案：C。2～4mm

解析：本题考查常见的饮片类型、规格及适用的品种。中药斜片的厚度应为2～4mm（C对）。片：片按照厚度可分为极薄片、薄片、厚片。极薄片的厚度要求为0.5mm（A错）以下；薄片的厚度要求为1～2mm（B错）；厚片的厚度要求为2～4mm。根据药材质地，一般质疏松宜厚，质密坚宜薄。质地极其致密坚实的木质类、动物骨和角类药材，宜切极薄片，如羚羊角、鹿角、降香等。质地致密、坚实者，宜切薄片，如乌药、槟榔、当归、白芍、三棱等。质地松泡、粉性大者，宜切厚片，如山药、天花粉、茯苓、甘草、黄芪、南沙参等。按照片型可分为顶片、斜片、直片。为了突出鉴别特征，或为了饮片外形的美观，或为了方便切制操作，视不同情况选择，直片如白术、天麻、附子等。斜片如桂枝、桑枝等。